用热性药治疗具有假热症状的病证，属于
A. 热因热用
B. 寒因寒用
C. 塞因塞用
D. 通因通用
E. 热者寒之

正确答案：A。热因热用

解析：虽然治疗假热，但实则仍为用温热方药以治其本（A对）；寒因寒用适用于里热炽盛，阳盛格的真热假寒证（B错）；塞因塞用适用于正气虚弱、运化无力所致的真虚假实证（C错）；通因通用适用于邪实阻滞、传化失司所致的真实假虚证；热者寒之即用寒药治热证（E错）。